有关发病率和患病率，下列说法正确的是
A. 患病率是反映疾病流行强度的指标
B. 罹患率和患病率本质上是一样的，只是观察时间不同
C. 发病率指一定时期内特定人群中患某病者所占的比例
D. 患病率＝发病率✕病程，因此已知任何一种疾病的发病率和病程，即可算出患病率
E. 发病率的分母中不包括具有免疫力和现患病而不会发病的人群

正确答案：E。发病率的分母中不包括具有免疫力和现患病而不会发病的人群